十二指肠溃疡易发生穿孔的部位是十二指肠
A. 球部后壁
B. 球部前壁
C. 水平部后壁
D. 升部前壁
E. 降部后壁

正确答案：B。球部前壁

解析：十二指肠溃疡穿孔多发生在球部前壁（B对）。胃溃疡穿孔多见于胃小弯。十二指肠溃疡出血多位于球部后壁，胃溃疡出血多位于小弯。